属于肝硬化门脉高压征的是
A. 蜘蛛痣
B. 脾肿大
C. 黄疸
D. 水肿
E. 肝肿大

正确答案：B。脾肿大

解析：脾肿大是由于门静脉压增高后脾脏慢性淤血，脾内纤维组织增生所致。一般为轻、中度肿大，部分可平脐或达到脐下（B对）。肝功能减退的临床表现是蜘蛛痣（A错）。肝硬化可又黄疸日久不愈转化而成（C错）。门静脉高压症的临床表现是腹水，腹部明显膨隆，腹壁紧张发亮，脐外凸，而不是水肿（D错）。肝肿大是肝硬化代偿期可出现肝肿大及质地改变（E错）。